主要辅料是碳酸氢钠和有机酸的剂型是
A. 气雾剂
B. 醑剂
C. 泡腾片
D. 口腔贴片
E. 栓剂

正确答案：C。泡腾片

解析：本题考查泡腾片。泡腾片（C对）的主要辅料是碳酸氢钠和有机酸，遇水可产生气体而呈泡腾状；气雾剂（A错）使用时是将内容物呈雾状物喷出；醑剂（B错）为挥发性药物的浓乙醇溶液，可以内服和外用；口腔贴片（D错）为粘贴于口腔，经黏膜吸收后起局部或全身作用的片剂；栓剂（E错）系指药物与适宜的基质制成的具有一定形状供腔道给药的固体外用制剂。